下列具有软坚作用的泻下药是
A. 大黄
B. 芒硝
C. 巴豆
D. 牵牛子
E. 火麻仁

正确答案：B。芒硝

解析：芒硝的功效是泻下通便，润燥软坚，清火消肿（B对）。大黄（A错）的功效是泻下攻积，清热泻火，凉血解毒，逐瘀通经，利湿退黄。巴豆（C错）的功效是峻下冷积，逐水退肿，豁痰利咽，外用蚀疮。牵牛子（D错）的功效是泻水通便，消痰涤饮，杀虫攻积。火麻仁（E错）的功效是润肠通便。